女，28岁。左乳皮肤水肿、发红2个月，口服抗生素未见好转。查体T37.0℃，左乳皮肤发红水肿，呈“桔皮样”，乳头内陷，乳房质地变硬，无触痛，未扪及肿块。左腋下扪及多个肿大淋巴结质硬融合，无触痛。血常规WBC8×10⁹/L，N0.67。最佳治疗方案是
A. 局部按摩
B. 静脉应用广谱抗生素
C. 穿刺活检后行左乳房切除术
D. 局部热敷理疗
E. 穿刺后活检化疗

正确答案：E。穿刺后活检化疗

解析：青年女性患者，左乳皮肤水肿、发红2个月（炎症样外观），口服抗生素无效（提示非感染性疾病）。体查：左乳皮肤发红、水肿，呈“桔皮样”（提示皮下淋巴管堵塞），乳头内陷，乳房质地变硬（病变累及乳管及乳头），无触痛，未扪及肿块。左腋下扪及多个肿大淋巴结，质硬、融合、无触痛（乳腺癌转移至腋窝淋巴结的典型临床表现）。血常规：WBC8.0×10⁹/L，N0.67（中性粒细胞比值约0.5～0.7），可基本排除感染性疾病可能。综合该患者的病史、体查及实验室检查，首先考虑的诊断是炎性乳腺癌。炎性乳腺癌为手术治疗的禁忌证，因此不采用穿刺活检后行左乳房切除术（C错）的治疗方案。该患者的最佳治疗方案是穿刺活检后应用化疗（E对）及放疗，可一定程度上延长患者的生存期。局部按摩（A错）、静脉应用广谱抗生素（B错）、局部热敷、理疗（D错）均属于急性乳腺炎的治疗措施，无助于炎性乳癌的治疗。